化妆品安全性评价中的动物实验中国际上的发展趋势
A. 在试验时避免使用动物
B. 在试验中尽量使用非哺乳动物
C. 在试验时在动物数量、伤害程度和替代试验上的考虑
D. 应优先考虑动物的保护
E. 完全取代动物实验

正确答案：C。在试验时在动物数量、伤害程度和替代试验上的考虑

解析：本题考查化妆品安全性评价中的动物实验中国际上的发展趋势。化妆品安全性评价中的动物实验中国际上的发展趋势为在试验时在动物数量、伤害程度和替代试验上的考虑（C对ABDE错）。